错误的是
A. 由下颌头、颞骨的下颌窝构成
B. 关节腔内有关节盘
C. 易向前脱位
D. 属联合关节
E. 无

正确答案：A。由下颌头、颞骨的下颌窝构成

解析：颞下颌关节下颌骨的下颌头与颞骨的下颌窝和关节结节构成（A错，为本题正确答案），属于联合关节（D对），两侧必须同时运动。关节囊松弛，内有纤维软骨构成的关节盘（B对）。关节囊的前份较薄弱，下颌关节易向前脱位（C对）。